根据《药品管理法》，下列情形中应当在法律规定的处罚幅度内从重处罚的有
A. 药品批发企业销售的假药以危重病人为主要使用对象
B. 药品生产企业生产的事前避孕药为假药
C. 药品零售企业销售假药，经药品监督管理部门处罚后再犯
D. 药品生产企业拒绝药品监督管理部门检查，伪造生产现场记录

正确答案：C、D。药品零售企业销售假药，经药品监督管理部门处罚后再犯；药品生产企业拒绝药品监督管理部门检查，伪造生产现场记录

解析：本题考查《药品管理法》中应当在法律规定的处罚幅度内从重处罚的情形。《药品管理法》第一百三十七条规定，有下列行为之一的，在本法规定的处罚幅度内从重处罚：（一）以麻醉药品、精神药品、医疗用毒性药品、放射性药品、药品类易制毒化学品冒充其他药品，或者以其他药品冒充上述药品；（二）生产、销售以孕产妇、儿童为主要使用对象的假药、劣药（A错）；（三）生产、销售的生物制品属于假药、劣药；（四）生产、销售假药、劣药，造成人身伤害后果；（五）生产、销售假药、劣药，经处理后再犯（C对）；（六）拒绝、逃避监督检查，伪造、销毁、隐匿有关证据材料，或者擅自动用查封、扣押物品。